以X线检查结果作为重要诊断依据的牙髓病是
A. 可复性牙髓炎
B. 急性牙髓炎
C. 慢性牙髓炎
D. 牙髓钙化
E. 牙髓坏死

正确答案：D。牙髓钙化

解析：牙髓钙化的临床表现：①临床无明显自觉症状。②部分病例疼痛类似慢性牙髓炎，发生与体位变化有关。偶见因髓石压迫牙髓神经可引起的放射性痛。③X线片检查：充满髓室较大的钙化物称为髓石（游离或附着）弥散的牙髓钙化变性可使整个髓腔闭塞，无根管的影像。掌握“牙髓坏死、牙髓钙化与牙内吸收”知识点。